腹腔干分支中，不包括
A. 脾动脉
B. 胃左动脉
C. 肝固有动脉
D. 胰十二指肠上动脉
E. 胰十二指肠下动脉

正确答案：E。胰十二指肠下动脉

解析：脾动脉（A对）、胃左动脉（B对）和肝总动脉为腹腔干的分支，肝固有动脉（C对）为肝总动脉的分支，胰十二指肠上动脉（D对）为肝固有动脉的分支。胰十二指肠下动脉（E错，为本题正确答案）为肠系膜下动脉的分支。